对药源性疾病的处置和治疗措施包括
A. 停用致病药物
B. 促进药物排出
C. 拮抗致病药物
D. 改用同类药物
E. 对症用药治疗

正确答案：A、B、C、E。停用致病药物；促进药物排出；拮抗致病药物；对症用药治疗

解析：本题考查药源性疾病治疗措施。停用致病药物（A对）、促进药物排出（B对）、拮抗致病药物（C对）、对症用药治疗（E对）均为对药源性疾病的处置和治疗措施，除以上四点外，对药源性疾病的处置和治疗措施还包括调整治疗方案。